又称滤泡囊肿的是
A. 始基囊肿
B. 含牙囊肿
C. 鼻腭囊肿
D. 角化囊肿
E. 正中囊肿

正确答案：B。含牙囊肿

解析：含牙囊肿又称滤泡囊肿。发生于牙冠或牙根形成之后，在缩余釉上皮与牙冠面之间出现液体渗出而形成含牙囊肿。可来自一个牙胚（含一个牙）；也有来自多个牙胚（含多个牙）者。掌握“牙源性颌骨囊肿”知识点。